原发性支气管肺癌的常见组织类型为
A. 腺癌
B. 小细胞肺癌
C. 大细胞肺癌
D. 混合性癌
E. 鳞癌

正确答案：E。鳞癌

解析：鳞状上皮细胞癌，简称鳞癌，多见于老年男性吸烟者，是肺癌中最常见的类型，占原发性肺癌的40%～50%，生长缓慢，转移晚，手术切除机会较多（E对）。腺癌女性多见，与吸烟无密切关系，约占原发性肺癌的25%（A错）。小细胞肺癌恶性程度高，很快出现肺外转移，占原发性肺癌的10%～15%（B错）。大细胞肺癌，癌细胞大，分化差，形态多样，核大，核仁显著，胞浆丰富，有黏液形成，常见大片出血性坏死，较小细胞肺癌转移晚，手术切除机会较大（C错）。鳞腺癌具有明确的腺癌和鳞癌组织结构，两种成分混杂在一起，或分别独立存在于同一个瘤体中（D错）。